好发于面部可能发生恶变的囊肿
A. 皮脂腺囊肿
B. 表皮样囊肿和皮样囊肿
C. 甲状舌管囊肿
D. 腮裂囊肿
E. 舌下囊肿

正确答案：A。皮脂腺囊肿

解析：本题考查皮脂腺囊肿。好发于面部可能发生恶变的囊肿为皮脂腺囊肿（A对），可恶变为皮脂腺癌。表皮样囊肿（B错）好发于眼睑、额、鼻、眶外侧、耳下等部位，皮样囊肿好发于口底、颏下；甲状舌管囊肿（C错）好发于颈正中线，以舌骨上下部位最常见；鳃裂囊肿（D错）好发于颈上部近下颌角处，胸锁乳突肌上1/3前缘；舌下囊肿（E错）特指发生于口底的黏液囊肿，这几种囊肿不发生恶变。